一名癫痫大发作的患者，因服用过量的苯巴比妥而引起昏迷，呼吸微弱，送医院急救。不该采取哪项措施
A. 人工呼吸
B. 静滴呋塞米
C. 静滴碳酸氢钠
D. 静滴氯化铵
E. 静滴贝美格

正确答案：D。静滴氯化铵